嵌体预备时，错误的做法是
A. 去尽病变腐质
B. 轴面最大周径线降至龈缘
C. 适当磨改异常的对颌牙
D. 提供良好的固位形和抗力形
E. 预防性扩展

正确答案：B。轴面最大周径线降至龈缘

解析：嵌体牙体预备的要求：去尽病变腐质、提供良好的固位形和抗力形、适当磨改异常的对颌牙、预防性扩展、洞缘制备45度斜面，去除薄壁弱尖。轴面最大周径线降至龈缘不是嵌体预备的要求，是全冠的预备要求。掌握“金属嵌体”知识点。